属于后纵隔的结构有
A. 奇静脉
B. 主动脉弓
C. 胸腺
D. 心包
E. 升主动脉

正确答案：A。奇静脉

解析：奇静脉属于后纵隔的结构（A对）。